甲状腺I度肿大是指甲状腺
A. 能看到肿大又能触及，但在胸锁乳突肌内侧
B. 不能看到，但能触及
C. 看不到又触不到
D. 能看到又能触及，并超过胸锁乳突肌外缘
E. 能看到又能触及，且超过甲状软骨上缘

正确答案：B。不能看到，但能触及

解析：甲状腺位于甲状软骨下方，紧贴在气管两侧，中以峡部相连，表现光滑，薄而柔软。甲状腺肿大可分三度：不能看出肿大但能触及者为I度（B对C错）；能看到肿大又能触及，但在胸锁乳突肌以内者为II度（A错）；超过胸锁乳突肌外缘者为Ⅲ度（DE错）。